某女，35岁。月经提前10日，量少，色淡质稀，腰膝酸软，头晕耳鸣，面色晦暗；舌淡暗苔白，脉沉细。宜选用的基础方剂是
A. 固阴煎
B. 膈下逐瘀汤
C. 温经汤
D. 人参归脾丸
E. 逍遥散

正确答案：A。固阴煎

解析：本题考查的是月经先期的辨证论治。月经提前10日，量少，色淡质稀，腰膝酸软，头晕耳鸣，面色晦暗；舌淡暗苔白，脉沉细。宜选用的基础方剂是固阴煎（A对）。月经先期：月经周期提前7天以上，甚至10余日一行，连续两个周期以上者，称为“月经先期”，既往亦称“经期超前”“经行先期”“经早”“经水不及期”等。月经先期属于以周期异常为主的月经病，常与月经过多并见，严重者可发展为崩漏，应及时进行治疗。西医学功能失调性子宫出血和盆腔炎等出现月经提前为主要表现时，可参考此内容辨证论治。（一）脾气虚证：【症状】月经周期提前，经量多，色淡红，质清稀；神疲乏力，气短懒言，小腹空坠，纳少便溏。舌淡红，苔薄白，脉细弱。【方剂应用】基础方剂为补中益气汤（黄芪、炙甘草、人参、当归、橘皮、升麻、柴胡、白术）或归脾汤（人参、黄芪、白术、当归、茯神、龙眼肉、酸枣仁、木香、远志、甘草、生姜、大枣）加减。【中成药应用】常用中成药有人参归脾丸（D错）（大蜜丸）、当归丸。（二）肾气虚证：【症状】月经周期提前，经量或多或少，色淡暗，质清稀；腰膝酸软，头晕耳鸣，面色晦暗或面有暗斑。舌淡暗，苔白，脉沉细。【方剂应用】基础方剂为固阴煎（人参、熟地、山药、山茱萸、远志、炙甘草、五味子、菟丝子）或归肾丸（熟地、菟丝子、山药、枸杞、茯苓、杜仲、山茱萸、当归）加减。（三）肝郁血热证：【症状】月经周期提前，经量或多或少，经色深红或紫红，质稠，经行不畅，或有块；或少腹胀痛，或胸闷胁胀，或乳房胀痛，或心烦易怒，口苦咽干。舌红，苔薄黄，脉弦数。【方剂应用】基础方剂为丹栀逍遥散（丹皮、栀子、当归、白芍、柴胡、白术、茯苓、煨姜、薄荷、炙甘草）加减。膈下逐瘀汤（B错）为痛经气滞血瘀证的方剂应用。痛经气滞血瘀证：【症状】经前或经期小腹胀痛，经血量少，行而不畅，经色紫暗有块，块下则痛减；乳房胀痛，胸闷不舒。舌质紫暗或有瘀点，脉弦。【方剂应用】基础方剂为膈下逐瘀汤（当归、川芎、赤芍、桃仁、红花、枳壳、延胡索、五灵脂、丹皮、乌药、香附、甘草）加减。温经汤（C错）为痛经寒凝血瘀证的中成药应用。痛经寒凝血瘀证：【症状】经行小腹冷痛，得热则舒，经量少，色紫暗有块；形寒肢冷小便清长。脉细或沉紧。【中成药应用】常用中成药有温经丸、少腹逐瘀丸、妇科万应膏。逍遥散（E错）为月经先后无定期肝郁证的方剂应用。月经先后无定期肝郁证：【症状】经来先后无定，经量或多或少，色暗红或紫红，有血块，或经行不畅；胸胁、乳房、少腹胀痛，脘闷不舒，时叹息，嗳气食少。苔薄白或薄黄，脉弦。【方剂应用】基础方剂为逍遥散（柴胡、当归、白芍、白术、茯苓、甘草、薄荷、煨姜）加减。